对绝经后骨质疏松者，在维生素D和钙制剂治疗基础上，可联合选用
A. 尼尔雌醇
B. 阿仑膦酸钠
C. 氢氯噻嗪
D. 尿促红素
E. 苯妥英钠

正确答案：A。尼尔雌醇

解析：本题考查骨质疏松症的药物治疗。尼尔雌醇（A对）与维生素D和钙制剂联合应用对绝经后妇女由于缺少雌激素而引起骨质疏松者有效。阿仑膦酸钠（B错）与维生素D和钙制剂联合用于治疗老年性骨质疏松。氢氯噻嗪（C错）为利尿药、抗高血压药。尿促性素（D错）治疗垂体功能低下的无排卵患者可使软泡发育。苯妥英钠（E错）为抗癫痫药、抗心律失常药。